某男，28岁。于烈日下工作后，出现高热，汗多，头痛面红，烦躁，小便赤；舌红少津，脉洪大。辨证为阳暑，治以白虎汤（石膏、知母、甘草、粳米）。此方中知母应选用的炮制品是
A. 盐炙品
B. 酒炙品
C. 生品
D. 清炒品
E. 麸炒品

正确答案：C。生品

解析：本题考查中暑之阳暑的方剂应用。此方中知母应选用的炮制品是生品（C对）。中暑之阳暑【症状】发热汗多，头痛面红，烦躁，胸闷，口渴多饮，溲赤，或兼见恶寒。舌红少津，脉洪大。【方剂应用】1.基础方剂：白虎汤（石膏、知母、甘草、粳米）加减。2.合理用药与用药指导：饮片选择：白虎汤出自东汉《伤寒论》。选用生知母，长于清热泻火，生津润燥，泻肺胃之火；选用生石膏，长于清热泻火，除烦止渴；选用炙甘草，以调和诸药。知母【炮制作用】知母味苦、甘，性寒。归肺、胃、肾经。生品苦寒滑利，具有清热泻火、生津润燥的功能。泻肺、胃之火尤宜生用。多用于外感热病，高热烦渴，肺热燥咳，内热消渴，肠燥便秘。盐知母（A错）可引药下行，专于人肾，增强滋阴降火的作用，善清虚热。常用于肝肾阴亏，虚火上炎，骨蒸潮热，盗汗遗精。如治阴虚火旺，潮热盗汗，咳嗽略血，耳鸣遗精的大补阴丸。